肺气肿患者心浊音界改变的特点是
A. 向左下扩大
B. 向右扩大
C. 向左右两侧扩大
D. 缩小
E. 不变

正确答案：D。缩小

解析：肺气肿患者心浊音界改变的特点是缩小（D对）。心浊音界向左下扩大（A错）见于主动脉瓣关闭不全者。心浊音界向左右两侧扩大（C错）见于肺源性心脏病或房间隔缺损等。心浊音界向右扩大（B错）不常见。心浊音界不变（E错）见于正常人及无心脏及肺部疾病者。